遗忘综合征的三大特征是
A. 谵妄、近记忆障碍、虚构
B. 近记忆障碍、幻觉、定向障碍
C. 近记忆障碍、虚构、定向障碍
D. 幻觉、虚构、定向障碍
E. 谵妄、虚构、定向障碍

正确答案：C。近记忆障碍、虚构、定向障碍

解析：遗忘综合症又称柯萨可夫综合征，患者无意识障碍，智能相对完好，主要表现为近事记忆障碍、定向力障碍和虚构（C对）。